治疗葡萄球菌肺炎最有效的药物为
A. 青霉素G
B. 磺胺类药物
C. 大环内酯类药物
D. 头孢菌素类药物
E. 万古霉素

正确答案：D。头孢菌素类药物

解析：万古霉素（E错）对于葡萄球菌产生强大的杀菌作用，尤其是MRSA（耐甲氧西林金黄色葡萄球菌），但因副作用较严重，故较少使用。青霉素G（窄谱青霉素类）（A错）是大多数葡萄球菌肺炎首选药物，近年来，葡萄球菌对青霉素G的耐药率已高达90%，故不选用。磺胺类药物（B错）属于广谱抑菌药。大环内酯类药物（C错）通常为抑菌作用，高浓度时有杀菌作用，常用于支原体、衣原体和军团菌的感染。头孢菌素类药物（D对）可用于耐青霉素G的葡萄球菌肺炎。